与深部感觉传导无关的结构是
A. 脊神经节
B. 脊髓后索
C. 内侧丘系
D. 丘脑腹外侧核
E. 中央后回

正确答案：D。丘脑腹外侧核

解析：深感觉是指肌、腿、关节等在不同状态（运动或静止）时产生的感觉（例如，人在闭眼时能感知身体各部的位置），又称本体感觉，包括位置觉、运动觉和震动觉。参与躯干和四肢意识性本体感觉和精细触觉传导通路的第一级神经元为脊神经节（A对），第二级神经元为内侧丘系（C对），第三级神经元为丘脑腹后外侧核（D对），最后投射至中央后回（E对）和中央前回。丘脑腹外侧核（D错，为本题正确答案）与深部感觉传导无关。